某药店对药品监督管理部门做出的责令停业决定不服，可以向上级行政机关提出
A. 行政许可
B. 行政处罚
C. 行政复议
D. 行政诉讼
E. 行政指导

正确答案：C。行政复议

解析：本题考查的是行政复议的范围。某药店对药品监督管理部门做出的责令停业决定不服，可以向上级行政机关提出行政复议（C对）。行政复议的概念：行政复议，是指公民、法人或者其他组织认为行政主体的具体行政行为侵犯其合法权益，依法向法定的行政复议机关提出复议申请，行政复议机关依照法定程序对被申请复议的具体行政行为的合法性和适当性进行审查并作出决定的一种法律制度。行政复议的范围：行政复议的受案范围是指法律规定的行政复议机关受理行政争议案件的权限范围。1.可申请复议的具体行政行为：根据《行政复议法》第6条规定，公民、法人或者其他组织认为行政机关作出的具体行政行为属于下列情形之一的，可申请行政复议：（1）对行政机关作出的警告、罚款、没收违法所得、没收非法财物、责令停产停业、暂扣或吊销许可证、暂扣或吊销执照、行政拘留等行政处罚不服的。（2）对行政机关作出的限制人身自由或者对财产的查封、扣押、冻结等行政行为不服的。（3）对行政机关作出的有关许可证、执照、资质、资格等证书变更、终止、撤销的决定不服的。（4）对行政机关作出的关于确认土地、矿藏、水流、森林、山岭、草原、荒地、滩涂、海域等自然资源的所有权或者使用权的决定不服的。（5）认为行政机关侵犯合法的经营自主权的。（6）认为行政机关变更或者废止农村承包合同，侵犯其合法权益的。（7）认为行政机关违法集资、征收财物、摊派费用或者违法要求履行其他义务的。（8）认为符合法定条件申请行政机关颁发许可证、执照、资质证、资格证等证书，或者申请行政机关审批、登记有关事项，行政机关没有依法办理的。（9）申请行政机关履行保护人身权利、财产权利或者受教育权利的法定职责，行政机关没有依法履行的。（10）申请行政机关依法发放抚恤金、社会保险金或者最低生活保障费，行政机关没有依法发放的。（11）认为行政机关的其他具体行政行为侵犯其合法权益的。行政许可（A错）：行政许可是指行政机关根据公民、法人或者其他组织的申请，经依法审查，准予其从事特定活动的行为。行政处罚（B错）：依照《中华人民共和国行政处罚法》（以下简称《行政处罚法》），公民、法人或者其他组织违反行政管理秩序的行为，应当给予行政处罚的，由法律、法规或者规章规定，并由行政机关依照《行政处罚法》规定的程序实施。没有法定依据或者不遵守法定程序的，行政处罚无效。行政诉讼（D错）的概述：行政诉讼是指公民、法人或者其他组织在认为行政机关或者法律、法规授权的组织作出的行政行为侵犯其合法权益时，依法定程序向人民法院起诉，人民法院对该行政行为合法性进行审查并作出裁决的活动。